女性，30岁。在颈丛麻醉下施行了甲状腺腺瘤切除术，手术顺利。该病人返回病房后应采用的卧位是
A. 平卧6小时，改半卧位
B. 平卧12小时，改半卧位
C. 高半坐卧位
D. 头低脚高位
E. 下肢抬高15°～20°，头部抬高20°～30°

正确答案：C。高半坐卧位

解析：甲状腺腺瘤切除术为颈部手术，术后多采用高半坐卧位（C对），以便于呼吸及有效引流。平卧位（AB错）常用于全身麻醉尚未清醒的病人（有利于口腔分泌物、呕吐物流出，避免误吸入气管）。头低脚高位（D错）常用于蛛网膜下隙阻滞的病人，以防止脑脊液外渗致头痛。下肢抬高15°～20°，头部和躯干抬高20°～30°（E错）的特殊体位主要用于休克病人，有利于提高回心血量，改善微循环。